饮用水净化中最常用的混凝剂是
A. 漂白粉
B. 硫酸钙
C. 硫酸铝
D. 臭氧
E. 硫代硫酸钠

正确答案：C。硫酸铝

解析：本题考查饮用水净化中最常用的混凝剂。常用的混凝剂有金属盐类混凝剂和高分子混凝剂两类，前者如铝盐和铁盐等；后者如聚合氯化铝和聚丙烯酰胺等。铝盐是饮用水净化中最常用的混凝剂，如硫酸铝（C对ABDE错）等。其优点是：腐蚀性小，使用方便，混凝效果好，且对水质无不良影响。